玄参在采收加工时应
A. 低温干燥
B. 蒸透心，敞开低温干燥
C. 发汗后再晒干或烘干
D. 反复曝晒、堆放至七八成干，再干燥
E. 阴干

正确答案：C。发汗后再晒干或烘干

解析：本题考查的是玄参的采收加工。玄参在采收加工时应发汗后再晒干或烘干（C对）。玄参：【采收加工】冬季茎叶枯萎时采挖根。除去根茎、幼芽（供留种栽培用）、须根及泥沙，晒或烘至半干，堆放3～6天“发汗”，反复数次至干燥。需低温干燥（A错）的药材有西洋参、白芷、川贝母、洋金花、枳壳、吴茱萸、砂仁、草果、益智、冬虫夏草、蟾酥、蛤蚧等。需蒸透心，敞开低温干燥（B错）的药材有天麻等。需反复曝晒、堆放至七八成干，再干燥（D错）的药材有麦冬等。需阴干（E错）的药材有徐长卿、木通、降香、沉香、侧柏叶、淫羊藿、款冬花、菊花、红花、瓜蒌、薄荷等。